有关乳剂特点的错误表述是
A. 乳剂中的药物吸收快，有利于提高药物的生物利用度
B. 水包油型乳剂中的液滴分散度大，不利于掩盖药物的不良臭味
C. 油性药物制成乳剂能保证剂量准确、使用方便
D. 外用乳剂能改善对皮肤、黏度的渗透性，减少刺激性
E. 静脉注射乳剂具有一定靶向性

正确答案：B。水包油型乳剂中的液滴分散度大，不利于掩盖药物的不良臭味

解析：本题考查乳剂。口服乳剂的特点：①乳剂中液滴的分散度很大，药物吸收快、药效发挥快及生物利用度高（A对）；②O/W型乳剂可掩盖药物的不良气味（B错，为本题正确答案）并可以加入矫味剂；③减少药物的刺激性及毒副作用（D对）；④可增加难溶性药物的溶解度，如纳米乳，提高药物的稳定性，如对水敏感的药物；⑤油性药物制成乳剂后，其分剂量准确，使用方便（C对）。⑥静脉注射乳剂，可使药物具有靶向作用，提高疗效（E对）。